肥厚型心肌病超声心动图显示
A. 左室扩大，流出道增宽，室间隔及左室后壁运动减弱
B. 室间隔非对称性肥厚，舒张期室间隔厚度与左室后壁之比≥1.3：1
C. 心前壁之前和心后壁之后有液性暗区
D. 瓣叶有赘生物及瓣叶穿孔
E. 舒张期二尖瓣前叶呈圆拱状，后叶活动度减弱，交界处融合，瓣叶增厚和瓣口面积减小

正确答案：B。室间隔非对称性肥厚，舒张期室间隔厚度与左室后壁之比≥1.3：1

解析：肥厚型心肌病（P266）（B对）是一种遗传性心肌病，以心室非对称性肥厚为解剖特点，其特异性超声心动图改变为心室不对称肥厚而无心室腔增大为其特征，舒张期室间隔厚度与左室后壁之比≥1.3：1。左室扩大，流出道增宽，室间隔及左室后壁运动减弱（A错）为扩张型心肌病（P263）的超声心动图表现。正常心包腔内可有20～30ml液体起润滑作用，超声心动图难以发现，若心前壁之前和心后壁之后有液性暗区（C错），则可确诊为心包积液。瓣叶有赘生物及瓣叶穿孔（D错）为感染性心内膜炎（P311）的超声心动图表现。舒张期二尖瓣前叶呈圆拱状，后叶活动度减弱，交界处融合，瓣叶增厚和瓣口面积减小（E错）为二尖瓣狭窄（P288）的典型超声心动图表现。